流脑的主要传播途是
A. 血液、体液、血液制品传播
B. 土壤传播
C. 飞沫传播
D. 水、食物、苍蝇传播
E. 吸血节肢动物传播

正确答案：C。飞沫传播

解析：流脑原菌主要经咳嗽、喷嚏借飞沫由呼吸道直接传播（C对）。因本菌在外界生存力极弱，故间接传播的机会较少、但密切接触如同睡、怀抱、接吻等对2岁以下婴幼儿亦可传播。